有一患者伤后表现单侧坐骨神经痛及腰痛，直腿抬高试验及加强试验阳性，脊柱侧弯，踝反射异常，足趾跖屈力减退，此时最可能的诊断是
A. L₁-₂椎间盘突出
B. L₂-₃椎间盘突出
C. L₃-₄椎间盘突出
D. L₄-₅椎间盘突出
E. L₅～S₁椎间盘突出

正确答案：E。L₅～S₁椎间盘突出

解析：患者单侧坐骨神经痛及腰痛（腰椎间盘突出症典型表现），直腿抬高试验及加强试验阳性、脊柱侧弯（腰椎间盘突出症重要体征），踝反射异常、足趾跖屈力减退，根据P755 腰神经根病变的神经定位图表，可知该患者受累神经为S1，结合患者典型症状和体征，此时最可能的诊断是L5-S1椎间盘突出（E对）。L1-2椎间盘突出（A错）对应L2受累，表现为大腿前中部感觉减退，髂腰肌肌力减弱。L2-3椎间盘突出（B错）对应L3受累，表现为股骨内髁感觉减退，股四头肌肌力减弱，膝反射减弱或消失。L3-4椎间盘突出（C错）对应L4受累，表现为内踝感觉减退，足背伸肌肌力减弱。L4-5椎间盘突出（D错）对应L5受累，表现为小腿外侧和足背痛触觉减退，拇趾背伸肌力减弱。